硫磺内服的功效是
A. 截疟解毒杀虫
B. 解毒止泻痢
C. 补火助阳通便
D. 开窍醒神
E. 重镇安神

正确答案：C。补火助阳通便

解析：硫黄性温而燥，外用有解毒杀虫、止痒疗疮的功效；内服补火助阳通便（C对）。